治疗痛经阳虚内寒证，宜选用的方剂是
A. 温经汤
B. 丹栀逍遥散
C. 固阴煎
D. 膈下逐瘀汤
E. 固冲汤

正确答案：A。温经汤

解析：本题考查的是痛经的辨证论治。治疗痛经阳虚内寒证，宜选用的方剂是温经汤（A对）。痛经是指女性正值经期或经行前后因胞宫气血变化，致病因素乘时而作所致的疾病，以周期性小腹疼痛，或痛引腰骶，甚则剧痛昏厥者为临床特征。西医学的原发性痛经和继发性痛经表现为上述症状者，可参考此内容辨证论治。（一）气滞血瘀证：【方剂应用】基础方剂为膈下逐瘀汤（D错）（当归、川芎、赤芍、桃仁、红花、枳壳、延胡索、五灵脂、丹皮、乌药、香附、甘草）加减。（二）寒凝血瘀证：【方剂应用】基础方剂为少腹逐瘀汤（小茴香、干姜、延胡索、没药、当归、川芎、肉桂、赤芍、蒲黄、五灵脂）加减。（三）湿热瘀阻证：【方剂应用】基础方剂为清热调血汤（牡丹皮、黄连、生地、当归、白芍、川芎、红花、桃仁、莪术、香附、延胡索）加减。（四）气血虚弱证：【方剂应用】基础方剂为圣愈汤（人参、黄芪、当归、川芎、熟地黄、白芍）加减。（五）肝肾亏虚证：【方剂应用】基础方剂为调肝汤（当归、白芍、山茱萸、巴戟天、阿胶、山药、甘草）加减。丹栀逍遥散（B错）为月经先期肝郁血热证的方剂应用。月经先期肝郁血热证：【方剂应用】基础方剂为丹栀逍遥散（丹皮、栀子、当归、白芍、柴胡、白术、茯苓、煨姜、薄荷、炙甘草）加减。固阴煎（C错）为月经先期肾气虚证的方剂应用。月经先期肾气虚证：【方剂应用】基础方剂为固阴煎（人参、熟地、山药、山茱萸、远志、炙甘草、五味子、菟丝子）或归肾丸（熟地、菟丝子、山药、枸杞、茯苓、杜仲、山茱萸、当归）加减。方剂应用为固冲汤（E错）的病证，2022年考试指南未明确说明。